腹部损伤时作诊断性腹腔穿刺，抽出不凝固血液，最可能的诊断为
A. 空腔脏器破裂
B. 误穿入腹腔血管
C. 前腹壁血肿
D. 实质性器官破裂
E. 后腹膜间隙血肿

正确答案：D。实质性器官破裂

解析：诊断性腹腔穿刺术在腹部损伤患者中的阳性率可达90%以上，对于判断腹腔内脏有无损伤和哪类脏器损伤有很大帮助。如果抽出不凝固血液，提示为实质性器官破裂（D对）所致的内出血，因腹膜的去纤维作用而使血液不凝。空腔脏器破裂（A错）出血量较少，腹腔穿刺一般不能抽出不凝血。误穿入腹腔血管（B错）而抽出的血液一般很快就会发生凝固；前腹壁血肿（C错）位于前腹壁，后腹膜间隙血肿（E错）位置较深，两者行诊断性腹腔穿刺均不能抽出血液。